副神经
A. 经枕骨大孔出入颅腔
B. 由疑核发出纤维形成
C. 仅支配胸锁乳突肌
D. 颅根加入舌咽神经
E. 属运动性脑神经

正确答案：E。属运动性脑神经

解析：副神经经枕骨大孔入颅，经颈静脉孔出颅（A错），由自疑核（延髓根）和副神经核（脊髓根）纤维形成（B错），支配咽喉肌和胸锁乳突肌（C错），属于运动性脑神经（E对）。